采用负压引流方法，去除引流物的时间是
A. 手术后24～48小时
B. 手术后12～24小时
C. 24小时内去除引流物
D. 一般在24小时内引流量少于20～30ml时去除
E. 脓液及渗出液完全消除为止

正确答案：D。一般在24小时内引流量少于20～30ml时去除

解析：负压引流一般在24小时内引流量少于20～30ml时去除。掌握“口外手术打结、缝合及外科引流”知识点。